患者，女，70岁，拟行膝关节置换术，无磺胺类药过敏史，皮试结果呈阴性。体征和实验室检查：低热，无感染，空腹血糖4.6mmol/L。手术医师处方抗菌药物预防感染。围术期预防性用药的起始给药时机是
A. 术前24小时
B. 术前0.5～2小时
C. 术中
D. 术后0.5～2小时
E. 术后24小时

正确答案：B。术前0.5～2小时

解析：本题考查围术期预防性用药的起始给药时机。围术期预防性用药的起始给药时机是术前0.5～2小时（B对）给药，可使围术期药物浓度达到最高，使药物预防感染的效果达到最大。术后预防性抗生素的时间不宜过长，尽可能缩短，要求能覆盖感染期，故过早给药可能使术后药物失效（A错）。预防性用药要保证手术部位在切开细菌植入时有足够的血浆药物浓度，故不能够术后给药（DE错）。手术中（C错）要尽量避免不必要的干扰因素，且术中给药不能保证药物达到峰浓度。